根据《中华人民共和国中医药法》下列中医药管理事项，实行备案管理的有
A. 医疗机构仅用传统工艺配制中药制剂品种
B. 委托其他取得《医疗机构制剂许可证》的医疗机构配制中药制剂
C. 生产符合国家规定条件的来源于古代经典名方的中药复方制剂
D. 在本医疗机构内炮制使用临床需要的市场上无供应的中药饮片

正确答案：A、B、D。医疗机构仅用传统工艺配制中药制剂品种；委托其他取得《医疗机构制剂许可证》的医疗机构配制中药制剂；在本医疗机构内炮制使用临床需要的市场上无供应的中药饮片

解析：本题考查的是医疗机构制剂注册制度。根据《中华人民共和国中医药法》下列中医药管理事项，实行备案管理的有医疗机构仅用传统工艺配制中药制剂品种（A对）、委托其他取得《医疗机构制剂许可证》的医疗机构配制中药制剂（B对）、在本医疗机构内炮制使用临床需要的市场上无供应的中药饮片（D对）。医疗机构制剂注册制度：《药品管理法》规定，医疗机构配制的制剂，应当是本单位临床需要而市场上没有供应的品种，并应当经所在地省级药品监督管理部门批准；但是，法律对配制中药制剂另有规定的除外。获得《医疗机构制剂许可证》的医疗机构，如果要进行某种制剂的配制，还必须报送有关资料和样品，经所在地省级药品监督管理部门批准，发给制剂批准文号后，方可配制。医疗机构制剂的申请人应当是持有《医疗机构执业许可证》并取得《医疗机构制剂许可证》的医疗机构。医疗机构配制制剂，应当按照经核准的工艺进行，所需的原料、辅料和包装材料等应当符合药用要求，不得擅自变更工艺、处方、配制地点和委托配制单位。需要变更的，申请人应当提出补充申请，报送相关资料，经批准后方可执行。医疗机构制剂批准文号的有效期为3年。有效期届满需要继续配制的，申请人应当在有效期届满前3个月按照原申请配制程序提出再注册申请，报送有关资料。医疗机构制剂的批准文号格式为：×药制字H（Z）＋4位年号＋4位流水号。其中，×—省、自治区、直辖市简称，H—化学制剂，Z—中药制剂。《中医药法》规定，医疗机构配制中药制剂，应当依照《药品管理法》的规定取得医疗机构制剂许可证，或者委托取得药品生产许可证的药品生产企业、取得医疗机构制剂许可证的其他医疗机构配制中药制剂。委托配制中药制剂，应当向委托方所在地省、级药品监督管理部门备案。医疗机构配制的中药制剂品种，应当依法取得制剂批准文号。但是，仅应用传统工艺配制的中药制剂品种，向医疗机构所在地省级药品监督管理部门备案后即可配制，不需要取得制剂批准文号。《中医药法》对医疗机构中药饮片管理的规定：对市场上没有供应的中药饮片，医疗机构可以根据本医疗机构医师处方的需要，在本医疗机构内炮制、使用。医疗机构应当遵守中药饮片炮制的有关规定，对其炮制的中药饮片的质量负责，保证药品安全。医疗机构炮制中药饮片，应当向所在地设区的市级人民政府药品监督管理部门备案。根据临床用药需要，医疗机构可以凭本医疗机构医师的处方对中药饮片进行再加工。《中医药法》规定，生产符合国家规定条件的来源于古代经典名方的中药复方制剂，在申请药品批准文号时（C错），可以仅提供非临床安全性研究资料。所称古代经典名方，是指至今仍广泛应用、疗效确切、具有明显特色与优势的古代中医典籍所记载的方剂。具体目录由国务院中医药主管部门会同药品监督管理部门制定。